患者，女，21岁。因喉炎而服用磺胺药物，继见皮肤红斑及血疱，口腔、阴部黏膜糜烂，伴有口干，便秘，溲赤，舌红苔薄，脉细数。诊断为固定性红斑型药疹，内治应首选
A. 消风散合黄连解毒汤
B. 萆薢渗湿汤或龙胆泻肝汤
C. 犀角地黄汤合黄连解毒汤
D. 清营汤
E. 普济消毒饮

正确答案：B。萆薢渗湿汤或龙胆泻肝汤

解析：药疹，亦称药毒，是指药物通过口服、注射或皮肤黏膜直接用药等途径，进入人体后所引起的皮肤或黏膜的急性炎症反应，相当于西医的药物性皮炎，其特点是发病前有用药史，并有一定的潜伏期，常突然发病，皮损形态多样，颜色鲜红，可泛发或仅限于局部，固定形红斑为药毒的常见类型之一，皮疹为局限性圆形或椭圆形水肿性红斑，颜色鲜红或紫红，重者中央有水疱，愈后留色素沉着，发作愈频则色素沉着越深，好发于口腔黏膜、唇缘、阴部、手足背等部位，本病明确诊断为固定性红斑型药疹，本病例证候为湿毒蕴肤证，方用萆薢渗湿汤或龙胆泻肝汤加减（B对）。